某女，76岁。患风寒湿痹20年，近见腰膝酸软、心衰性水肿，宜选用的药是
A. 秦艽
B. 川乌
C. 络石藤
D. 伸筋草
E. 香加皮

正确答案：E。香加皮

解析：本题考查的是香加皮的主治病证。患风寒湿痹20年，近见腰膝酸软、心衰性水肿，宜选用的药是香加皮（E对）。香加皮：【主治病证】（1）风寒湿痹，腰膝酸软。（2）水肿（尤宜心衰性水肿），小便不利。秦艽（A错）：【主治病证】（1）风湿热痹，风寒湿痹，表证夹湿。（2）骨蒸潮热。（3）湿热黄疸。川乌（B错）：【主治病证】（1）风寒湿痹，寒湿头痛。（2）心腹冷痛，寒疝腹痛。（3）局部麻醉（外用）。络石藤（C错）：【主治病证】（1）风湿痹痛，筋脉拘挛。（2）喉痹，痈肿。伸筋草（D错）：【主治病证】（1）风湿痹痛，关节酸痛，屈伸不利。（2）跌打损伤。